患儿，女，5岁，误服香豆素灭鼠药，可选用的解救药物是
A. 亚甲蓝
B. 纳洛酮
C. 二巯丙醇
D. 维生素K₁
E. 乙酰半胱氨酸

正确答案：D。维生素K₁

解析：本题考查维生素K₁。香豆素类杀鼠药中毒，可静脉滴注维生素K₁（D对）10～30mg，一日1～3次，严重出血时每日总量可用至300mg，维生素K₃、维生素K₄无效。亚甲蓝（A错）用于对化学物亚硝酸盐、硝酸盐、苯胺等和含有或产生芳香胺的药物引起的高铁血红蛋白血症有效；对先天性还原型二磷酸吡啶核苷高铁血红蛋白还原酶缺乏引起的高铁血红蛋白血症效果较差；对异常血红蛋白M伴有高铁血红蛋白血症无效，对急性氰化物中毒、能暂时延迟其毒性。纳洛酮（B错）用于急性酒精中毒，限于步态不稳定、话多、不连贯、欣快、共济失调、感知迟钝、困倦、嗜睡，但不伴有昏迷及生命体征改变的急性酒精中毒的酩酊状态以及急性阿片类中毒（表现为中枢神经和呼吸抑制）。二巯丙醇（C错）用于砷、汞、金、铋及酒石酸锑钾中毒。乙酰半胱氨酸（E错）用于对乙酰氨基酚过量所致中毒的解救。